患者胸闷气短，甚则胸痛彻背，心悸汗出，腰酸乏力，畏寒肢冷，唇甲淡白，舌淡白，脉沉微欲绝。治疗应首选
A. 参附汤合右归饮
B. 人参养营汤合左归饮
C. 炙甘草汤合生脉散
D. 苓桂术甘汤合左归丸
E. 苏合香丸合左归饮

正确答案：A。参附汤合右归饮

解析：根据“胸闷气短，甚则胸痛彻背，心悸汗出”可知病为“胸痹”；根据“乏力，畏寒肢冷，唇甲淡白，舌淡白，脉沉微欲绝”可辨为“心肾阳虚证”，治疗应温补阳气，振奋心阳，用参附汤合右归饮（A对）。左归丸与左归饮功用为补益肾阴，主治真阴不足证，与本题辩证不符（BDE错）。炙甘草汤为治气血阴阳虚损证之常用方 以虚羸少气，心动悸，脉结代为辨证要点（C错）。